我国目前监测的主要疾病是
A. 地方病
B. 肿瘤
C. 传染病
D. 非传染病
E. 性病

正确答案：C。传染病